关于胰腺炎诊断中血、尿淀粉酶检测的叙述不正确的是
A. 血清淀粉酶值在发病后3～12小时开始升高，24～48小时达到高峰，7天内恢复正常
B. 尿淀粉酶升高稍迟但持续时间比血淀粉酶长
C. 淀粉酶值的高低与病情的轻重不一定成正比
D. 严重的坏死性胰腺炎，血、尿淀粉酶值反而不升高
E. 以上叙述都不对

正确答案：E。以上叙述都不对

解析：血、尿淀粉酶检测为急性胰腺炎常用而主要的诊断方法。血清淀粉酶一般于发病2小时后开始升高，24小时达高峰，4～5天后逐渐下降（A对）；尿淀粉酶于发病后24小时开始升高，48小时达到高峰，持续1～2周才缓慢下降；所以尿淀粉酶升高稍迟但持续时间比血淀粉酶长（B对）。血清淀粉酶活性高低与病变严重程度不呈相关性（C对）。严重的坏死性胰腺炎，血、尿淀粉酶值反而不升高（D对）（E错，为本题正确答案）。